用后不宜马上进食的剂型是
A. 软膏剂
B. 含漱剂
C. 直肠栓剂
D. 滴眼剂
E. 透皮贴剂

正确答案：B。含漱剂

解析：本题考查含漱剂。用后不宜马上进食的剂型是含漱剂（B对）。软膏剂（A错）应用时应注意：①涂敷前将皮肤清洗干净。②对有破损、溃烂、渗出的部位一般不要涂敷。③涂布部位有烧灼或瘙痒、发红、肿胀、出疹等反应，须立即停药，并将局部药物洗净。④部分药物涂敷后采用封包可显著地提高角质层的含水量。⑤涂敷后轻轻按摩可提高疗效。⑥不宜涂敷于口腔、眼结膜。直肠栓剂（C错）应用时应注意：①栓剂应用前宜将其置入冰水或冰箱中10～20分钟，待其基质变硬。②剥去栓剂外裹的铝箔或聚乙烯膜，在栓剂的尖端前涂少许液状石蜡、凡士林、植物油或润滑油。③塞入时患者取侧卧位。④放松肛门，把栓剂的尖端插入肛门，深度距肛门口在幼儿约2cm、成人约3cm，合拢双腿并保持侧卧姿势15分钟，以防栓剂被压出。⑤用药前先排便，用药后1～2小时内尽量不排便（刺激性泻药除外）。⑥有条件者可在肛门外塞一点脱脂棉或纸巾，以防基质融化漏出而污染衣被。滴眼剂（D错）应用时应注意：①清洁双手，将头部后仰，眼向上望，用食指轻轻将下眼睑拉开成一钩袋状。②将药液从眼角侧滴入眼袋内，一次滴1～2滴。滴药时应距眼睑2～3cm，勿使滴管口触及眼睑或睫毛，以免污染。③滴后轻轻闭眼1～2min。④用手指轻轻按压眼内眦。⑤若同时使用2种药液，宜间隔10min。⑥若滴入有毒性药液，滴后应用棉球压迫泪囊区2～3min，以免药液经泪道流入泪囊和鼻腔，经黏膜吸收后引起中毒反应。⑦一般先滴右眼后滴左眼，以免用错药，如左眼病较轻，应先左后右，以免交叉感染。⑧如眼内分泌物过多，应先清理分泌物。⑨滴眼剂不宜多次打开使用，连续应用1个月不应再用，如药液出现混浊或变色时，切勿再用。⑩白天宜用滴眼剂滴眼，反复多次，临睡前应用眼膏剂涂敷。透皮贴剂（E错）应用时应注意：①用前将所要贴敷部位的皮肤清洗干净，并稍稍晾干。②从包装内取出贴片，揭去附着的薄膜，但不要触及含药部位。③贴于无毛发或是刮净毛发的皮肤上，轻轻按压使之边缘与皮肤贴紧，不宜热敷。④皮肤有破损、溃烂、渗出、红肿的部位不要贴敷；⑤不要贴在皮肤的皱褶处、四肢下端或紧身衣服底下，选择一处不进行剧烈运动的部位，如胸部或上臂。⑥定期或遵医嘱更换，若发现给药部位出现红肿或刺激症状，可向医生咨询。